材料一：甲因其子（8周岁）连续咳嗽一周，到某药品零售连锁企业门店购药。当时该零售企业执业药师不在岗，由工作人员乙详细询问甲，了解患者是否发烧、是否咳痰，在得知未发烧、咳黄痰后，向甲推荐盐酸氨溴索口服液（按甲类非处方药管理）和维生C素泡腾片（按乙类非处方药管理），甲凭以往用药经验，向乙提出新的购药需求购买中成药抗病毒口服液（外包装上有绿色OTC标识）和小儿退烧药。甲购买药品给其子使用一周后，症状未改善。甲再次前往该门店，向门店执业药师表示想购买磷酸可待因糖浆给其子使用。乙在销售维生素C泡腾片时，如果出现下列行为，其中，不符合药品经营管理要求的是
A. 向甲销售维生素C泡腾片2盒，并赠送1小包创可贴
B. 向甲提供维生素C泡腾片的书面用药指导资料
C. 向甲销售维生素C泡腾片2盒，并赠送1盒盐酸氨溴索口服液
D. 向甲销售维生素C泡腾片2盒，赠送1盒

正确答案：C。向甲销售维生素C泡腾片2盒，并赠送1盒盐酸氨溴索口服液

解析：本题考查的是药品零售企业销售非处方药的要求。药品零售企业不得采用“捆绑搭售”“买商品赠药品”“买N赠1”“满N减1”“满N元减×元”等方式直接或变相赠送销售处方药、甲类非处方药（包括通过网络销售的渠道）（C错，为本题正确答案）。药品零售企业销售非处方药的要求：药品零售企业可不凭医师处方销售非处方药，但执业药师或其他药学技术人员应当向个人消费者提供必要的药学服务，指导其合理用药或提出寻求医师治疗的建议。销售乙类非处方药时，执业药师或其他药学技术人员应当根据个人消费者咨询需求，提供科学合理的用药指导；销售甲类非处方药时，执业药师应当主动向个人消费者提供用药指导。药品零售企业不得采用开架自选的方式销售处方药，也不得采用“捆绑搭售”“买商品赠药品”“买N赠1”“满N减1”“满N元减×元”等方式直接或变相赠送销售处方药、甲类非处方药（包括通过网络销售的渠道）。非人工自助售药设备不得销售除乙类非处方药外的其他药品。在特殊管理的药品销售方面，药品零售企业应当严格遵守国家相关规定：对于曲马多口服复方制剂以及单位剂量麻黄碱类药物含量大于30mg（不含30mg）的含麻黄碱类复方制剂，一律列入必须凭处方销售的药品范围，无医师处方严禁销售。药品零售企业销售上述药品应当查验购买者的身份证原件，并对其姓名和身份证号码予以登记。除凭医师处方按处方剂量销售外，对于属于非处方药的含麻黄碱类复方制剂一次销售不得超过2个最小包装。药品零售企业不得开架销售上述药品，应当设置专柜由专人管理、专册登记，登记内容包括药品名称、规格、销售数量、生产企业、生产批号、购买入姓名、身份证号码。药品零售企业发现超过正常医疗需求，大量、多次购买上述药品的，应当立即向当地药品监管部门和公安机关报告。